女，33岁。上颌前部被硬物撞击，经X线检查证实为上颌前部的牙槽突骨折伴牙龈撕裂伤。该患者需要进行的处理是
A. 定期复诊观察
B. 合理营养
C. 单颌复位固定，缝合牙龈创口
D. 保守治疗
E. 颌间结扎

正确答案：C。单颌复位固定，缝合牙龈创口

解析：本题考查牙槽突骨折。患者，女，33岁，上颌前部牙槽突骨折伴牙龈撕裂伤。该患者需要进行的处理是单颌复位固定，缝合牙龈创口（C对）。临床上牙槽突骨折常伴有唇和牙龈组织的撕裂、肿胀、牙松动、牙折或牙脱落。当摇动损伤区的牙时，可见邻近数牙及骨折片随之移动。骨折片可移位而引起咬合错乱。治疗应在局麻下将牙槽突及牙复位到正常解剖位置（AD错），然后利用骨折邻近的正常牙列，采用牙弓夹板、金属丝结扎、正畸托槽方丝弓和接骨板等方法固定骨折（E错）。注意牙弓夹板和正畸托槽的放置均应跨过骨折线至少3个牙位，才能固定可靠。牙槽突骨折常伴有牙脱位及牙髓坏死，应由牙髓病专科医师共同处理（B错）。